一健康女婴，体重8kg，身长68cm，已能抓物、换手、独坐久，能发复音。其符合的最早月龄是
A. 13~15个月
B. 11~12个月
C. 9~10个月
D. 4~6个月
E. 7~8个月

正确答案：E。7~8个月

解析：小儿身长为68cm，可知该小儿在12月以下，身高=65+（月龄-6）×1.5，可得该小儿的月龄为8月左右；体重=6+月龄×0.25=8，得月龄为8月；另外从小儿已能抓物、换手、独坐久，能发复音的表现，也可以再次确定该小儿的月龄为8个月左右（E对）。